权利和义务在医疗活动中，对医患都不可或缺，因为
A. 权利与义务可以互相转化
B. 这是义务论的要求
C. 没有权利就无从谈义务，反之亦然
D. 这是法律规定的
E. 医患双方的权利与义务是相辅相成互为条件的

正确答案：E。医患双方的权利与义务是相辅相成互为条件的

解析：权利和义务在医疗活动中，对医患都不可或缺，因为医患双方的权利与义务是相辅相成互为条件的。医生的权利包括：诊治权、特殊干涉权、工作学习权、参与权。医生的义务：为病人尽职尽责，维护病人的健康，减轻其痛苦。医生为病人尽义务应该是无条件的，医生有解释、说明病情和医疗保密的义务。患者的权利：平等的医疗权、疾病的认知权、知情同意权、诉讼权与获得赔偿权、要求保护隐私权、免除一定社会责任权。患者的义务：保持和恢复健康的责任、积极接受、配合诊治的义务、遵守医院各种规章制度的义务、支持医学科学发展的义务（E对）。